硝酸酯类抗心绞痛药使用过程中可发生耐药现象。关于预防和减少其耐药性的方法，正确的有
A. 采用小剂量、间断静脉滴注硝酸甘油，每日保持8～12h的低血药浓度期或无药期
B. 采现偏离心脏的给药方式，口服硝酸酯应有一段时间的无硝酸酯浓度期或低硝酸酯浓度期
C. 联合使用巯基供体类药，如卡托普利，可能改善硝酸酯类耐药
D. 联合使用β受体阻断剂、他汀类药物对预防耐药现象可能有益
E. 口服用药易发生耐药性，可改用无首过效应和不易发生耐药的透皮贴剂

正确答案：A、B、C、D、E。采用小剂量、间断静脉滴注硝酸甘油，每日保持8～12h的低血药浓度期或无药期；采现偏离心脏的给药方式，口服硝酸酯应有一段时间的无硝酸酯浓度期或低硝酸酯浓度期；联合使用巯基供体类药，如卡托普利，可能改善硝酸酯类耐药；联合使用β受体阻断剂、他汀类药物对预防耐药现象可能有益；口服用药易发生耐药性，可改用无首过效应和不易发生耐药的透皮贴剂

解析：本题考查预防硝酸酯类药物耐药性的方法。关于预防和减少硝酸酯类抗心绞痛药耐药性的方法，正确的有：采用小剂量、间断静脉滴注硝酸甘油，每日保持8～12h的低血药浓度期或无药期（A对）。采现偏离心脏的给药方式，口服硝酸酯应有一段时间的无硝酸酯浓度期或低硝酸酯浓度期（B对）。联合使用巯基供体类药，如卡托普利，可能改善硝酸酯类耐药（C对）。联合使用β受体阻断剂、他汀类药物对预防耐药现象可能有益（D对）。口服用药易发生耐药性，可改用无首过效应和不易发生耐药的透皮贴剂（E对）。